下列不是中医对子宫脱垂的称谓是
A. 阴茧
B. 阴蕈
C. 阴挺
D. 阴脱
E. 阴颓

正确答案：A。阴茧

解析：外阴溃疡中医称为阴疮、阴蚀、阴茧（A错，为本题正确答案）；子宫脱垂又名子宫脱出、阴挺、阴脱、阴癫、阴颓、阴蕈、瘣疾、子宫不收、子肠不收、翻花（BCDE对）。